人脑对客观事物的现象和本质的反映过程是
A. 情感过程
B. 认知过程
C. 意志过程
D. 理念过程
E. 记忆过程

正确答案：B。认知过程

解析：本题考查心理学概述。认知过程（B对）：是接受、加工、贮存和理解各种信息的过程，也就是人脑对客观事物的现象和本质的反映过程。